某家庭，父亲及儿子都抽烟，母亲肥胖，从不进行体育锻炼，女儿上大学，在学校居住，每天坚持锻炼，饮食合理。这家父亲、母亲及儿子具有
A. 日常健康行为
B. 避开环境危害行为
C. 预警行为
D. 预防性行为
E. 不良生活方式

正确答案：E。不良生活方式